卡托普利抑制下列哪种酶
A. Na⁺，K⁺-ATP酶
B. 碳酸酐酶
C. 血管紧张素转化酶
D. 胆碱酯酶
E. 磷酸二酯酶

正确答案：C。血管紧张素转化酶

解析：本题考查卡托普利。卡托普利为血管紧张素转化酶（C对）抑制剂（ACEI），临床用于治疗高血压。奥美拉唑可抑制胃壁细胞Na⁺，K⁺-ATP酶（A错）活性，减少胃酸分泌，保护胃黏膜。乙酰唑胺为碳酸酐酶（B错）抑制剂，能阻止肾近曲小管和其它部位对碳酸氢钠的重吸收，为低效利尿剂。新斯的明为胆碱酯酶（D错）抑制剂，抑制乙酰胆碱的水解。米力农、氨力农属于磷酸二酯酶（E错）抑制剂，临床用于心力衰竭。